引起缺钾和低钾血症的最主要原因是
A. 钾丢失过多.
B. 碱中毒
C. 长期使用β受体激动剂
D. 钾摄入不足
E. 低钾性周期性麻痹

正确答案：A。钾丢失过多.

解析：严重呕吐、腹泻、大量出汗、长期大量使用利尿剂等可导致钾丢失过多（A对）而引起低钾血症。碱中毒（B错）、长期使用β受体激动剂（C错）、钾摄入不足（D错）、低钾性周期性麻痹（E错）都可导致低钾血症，但不是最主要原因。